一男婴，营养状况良好，头围46cm，前囟0.5cm，身长75cm。最可能的月龄是
A. 4个月
B. 8个月
C. 10个月
D. 6个月
E. 12个月

正确答案：E。12个月

解析：身高的增长：出生身长平均50cm，1岁身长约75cm，2岁时身长约87cm，2~12岁，身高=年龄（岁）×7+75；头围的增长：出生时头围相对大，平均33~34cm，1岁时头围约46cm，2岁时头围约48cm，头围的测量在2岁以内最有价值。本例患儿头围46cm，身长75cm，均符合1岁小儿体格生长规律，1岁即12个月（E对）。